下述物质中属于单纯性窒息性气体的是
A. 一氧化碳
B. 氯气
C. 苯
D. 二氧化碳
E. 氯乙烯

正确答案：D。二氧化碳